青光眼病人的眼压约在22～42mmHg范围，非青光眼病人的眼压约在14～26mmHg范围内，根据这些资料，可以认为：将筛检标准值定在下列哪一个范围较合适
A. 22～42mmHg
B. 22～26mmHg
C. 14～22mmHg
D. 26～42mmHg
E. 15～42mmHg

正确答案：B。22～26mmHg

解析：本题考查确定连续性测量指标的阳性截断值。青光眼病人的眼压约在22～42mmHg范围，非青光眼病人的眼压约在14～26mmHg范围内，根据这些资料应将筛检标准值定在22～26mmHg（B对ACDE错）。部分重叠双峰分布当总人群分布呈双峰型，病人和非病人分布曲线小部分重叠。此时，在22mmHg和26mmHg之间既有病人又有非病人，形成一个重叠区。在22mmHg至26mmHg当截断值向非病人的最高值方向26mmHg移动，特异度升高，灵敏度降低；反之，当截断值向病人的最低值方向22mmHg移动时，灵敏度增大，特异度降低。所以综合考虑应将筛检标准值定在22～26mmHg。